男,70岁。戴下颌活动义齿半年,昨日咬物时折断。查：右下24567左下24567黏膜支托式可摘局部义齿。3处舌侧基托纵折。两断端约1.5mm厚。咬合接触良好。造成基托折断的原因是
A. 基托过薄
B. 咬过硬食物
C. 习惯单侧咀嚼
D. 取戴义齿方法不正确
E. 牙槽嵴吸收，现基托与组织不密合

正确答案：A。基托过薄

解析：本题考查造成基托折断的原因。此患者大面积远中游离缺失，应制作黏膜支持式义齿，3处舌侧基托纵折说明应力集中在此处，断端约1.5mm厚小于2mm，因此基托过薄（A对）是基托折断的原因。咬过硬食物（B错）、习惯单侧咀嚼（C错）、取戴义齿方法不正确（D错）也会导致基托折断，但是在患者主诉中并未提到。牙槽嵴吸收，基托与组织不密合（E错）会造成固位力不足，义齿不稳定，但不会引起基托折断。